苷类化合物是指
A. 多元醇
B. 含有羟基的羧酸
C. 酸和碱形成的化合物
D. 糖与非糖物质形成的化合物
E. 含有氨基酸的化合物

正确答案：D。糖与非糖物质形成的化合物

解析：本题考查的是苷的概念。苷类化合物是指糖与非糖物质形成的化合物（D对）。苷类，即配糖体，是糖或糖的衍生物如氨基糖、糖醛酸等与另一非糖物质通过糖的端基碳原子连接而成的化合物。多元醇（A错）有甘油、山梨醇等。含有羟基的羧酸（B错）为羟基羧酸，如酒石酸等。酸和碱形成的化合物（C错）即盐，如柠檬酸盐、草酸盐、酒石酸盐等。含有氨基酸的化合物（E错）即氨基酸衍生物，如多肽、蛋白质等。